对3000人进行随访，暴露于A因子的1000人中，100人发生某病，而未暴露于A因子的2000人中也有100人发生某病，该研究中，与非暴露组相比，暴露于A因子发生某病的相对危险度是
A. 1
B. 1.5
C. 2
D. 3
E. 不能计算

正确答案：C。2

解析：本题考查相对危险度的计算。相对危险度比是暴露组的危险度（测量指标是累积发病率）与对照组的危险度之比。计算为相对危险度＝（100/1000）/（100/2000）＝2（C对ABDE错）。